婴儿少尿的标准是每日尿量少于
A. 200ml
B. 100ml
C. 50ml
D. 250ml
E. 150ml

正确答案：A。200ml

解析：婴儿少尿的标准是每日尿量少于200ml（A对）。